甘草的入药部位为
A. 入药部位为根
B. 入药部位为根茎
C. 两者均是
D. 两者均不是

正确答案：C。两者均是

解析：本题考查的是甘草的来源。甘草的入药部位为根与根茎（C对）。甘草：【来源】为豆科植物甘草、胀果甘草或光果甘草的干燥根（A错）及根茎（B错）。入药部位为根的中药有牛膝、川牛膝、商陆、银柴胡、白芍、赤芍、板蓝根、地榆、苦参、葛根、粉葛、黄芪、西洋参、白芷、当归等。入药部位为根茎的中药有狗脊、黄连、升麻、北豆根、川芎、胡黄连、白术、苍术、香附、石菖蒲、黄精、玉竹、重楼、土茯苓、知母、射干、莪术、姜黄等。